二次印模制取时要用修整刀修去初印模中患牙周边范围为
A. 1mm
B. 1～2mm
C. 2mm
D. 2～3mm
E. 3mm

正确答案：B。1～2mm

解析：两步法取印模先混合油泥型硅橡胶放入托盘并制取初印模，待初印模结固后取出，用修整刀修去印模中患牙周边1～2mm范围的印模材料以及阻碍印模二次复位部分，并形成排溢沟。掌握“暂时冠及印模与模型”知识点。